下述哪个孔、管不与颅中窝相通
A. 颈静脉孔
B. 圆孔
C. 棘孔
D. 破裂孔
E. 视神经管

正确答案：A。颈静脉孔

解析：颈静脉孔与颅后窝相通（A错，为本题正确答案）。圆孔（B对）、棘孔（C对）、破裂孔（D对）、视神经管（E对）均是与颅中窝相通。